按情感内容从低层次到高层次、理性成分从小到大排列的医德情感序列是
A. 责任感-同情感-事业感
B. 责任感-事业感-同情感
C. 同情感-责任感-事业感
D. 同情感-事业感-责任感
E. 事业感-同情感-责任感

正确答案：C。同情感-责任感-事业感